一种广谱抗生素，是控制伤寒、斑疹伤寒、副伤寒的首选药物
A. 磺胺嘧啶
B. 头孢氨苄
C. 甲氧苄啶
D. 青霉素钠
E. 氯霉素

正确答案：E。氯霉素

解析：本题考查氯霉素。氯霉素（E对）为敏感菌株所致伤寒、副伤寒的首选药物。磺胺嘧啶（A错）为二氢叶酸合成酶的竞争性抑制剂，能通过血脑屏障进入脑脊液，曾被用作治疗流行性脑膜炎的首选药。头孢氨苄（B错）为β-内酰胺类抗生素，能抑制细胞壁的合成，产生较强的杀菌效应。甲氧苄啶（C错）为抗菌增效剂。青霉素钠（D错）是天然的抗菌药，适用于革兰阳性球菌所致的感染以及破伤风。